准备送颌面部外伤的昏迷患者到医院，不应采取的措施是
A. 采用俯卧位
B. 额部垫高
C. 口鼻悬空有利于唾液外流
D. 避免血凝块及分泌物堆积在口咽部
E. 采用仰卧位

正确答案：E。采用仰卧位

解析：运送患者时应注意保持呼吸道通畅。昏迷患者可采用俯卧位，额部垫高，使口鼻悬空，有利于唾液外流和防止舌后坠。一般患者可采取侧卧位或头侧向一侧，避免血凝块及分泌物堆积在口咽部。掌握“口腔颌面部创伤急救”知识点。